牛黄醒消丸注意事项的表述，正确的是
A. 热毒疮慎用
B. 可以长期使用
C. 孕妇可酌情使用
D. 疮阴证者禁用
E. 只可外用不可内服

正确答案：D。疮阴证者禁用

解析：本题考查的是牛黄醒消丸的注意事项。牛黄醒消丸注意事项的表述，正确的是疮阴证者禁用（D对）。牛黄醒消丸：【用法用量】用黄酒或温开水送服（E错）。水丸一次3g，一日1～2次。患在上部，临睡前服；患在下部，空腹时服。【注意事项】孕妇禁用（C错）。疮疡阴证者禁用。脾胃虚弱者、身体虚者慎用。不宜长期使用（B错）。若用药后出现皮肤过敏反应应及时停用。忌食辛辣、油腻食物及海鲜等发物。注意事项为热毒疮慎用（A错）的中成药，2022年考试指南未明确说明。